决定细菌性别的是
A. F质粒
B. R质粒
C. Vi质粒
D. Col质粒
E. γ决定因子

正确答案：A。F质粒